反应口腔卫生状况
A. 菌斑百分率
B. 附着丧失
C. 探诊出血
D. 牙龈红肿
E. 探诊深度

正确答案：A。菌斑百分率

解析：本题考查牙周组织检查。反应口腔卫生状况为菌斑百分率（A对）。菌斑作为临床研究的观察指标，则应按菌斑指数分级记录。菌斑显示的意义在于既有帮助患者自查口腔卫生状况的指示作用，还可帮助医师针对患者个人的实际情况进行对应的口腔卫生措施指导和示教。探诊出血（C错）：根据探诊后有无出血，记为BOP阳性或阴性，这已被视为牙龈有无炎症的较客观指标，特别是将探针插入牙周袋底后是否出血已被普遍接受作为评估龈下炎症的方法。牙龈红肿（D错）：多提示牙龈发炎，对于临床疾病的诊断与治疗，还需借助于其他相关专科检查。探诊深度（E错）：与龈下牙菌斑生物膜和炎症状况密切相关，是决定牙周治疗的重要依据。但因为很少有龈缘恰与釉牙骨质界相一致的情况，因此该项指标往往并不能反映出实际的牙周支持组织丧失情况，临床上更多的是通过附着水平（B错）来反映牙周附着丧失的情况。